巨幼细胞贫血用
A. 铁剂
B. 叶酸
C. 维生素B
D. 维生素K
E. 肝素

正确答案：B。叶酸